25岁女性，妊娠24周，昨夜发热，今朝颜面部及周身出现皮疹，查体皮疹为粟粒大红色丘疹，两侧耳后可触及数个淋巴结，风疹病毒抗体效价为1∶8，进而最合适的处置方法是
A. 给予抗生素进行治疗
B. 注射免疫球蛋白制剂
C. 给予干扰素进行治疗
D. 立即采取中止妊娠措施
E. 2周后再检查抗体效价

正确答案：E。2周后再检查抗体效价